恶性黑色素瘤患者预后大多不良，与其预后不良不相关的是
A. 肿瘤侵犯血管、坏死
B. 多形性细胞群
C. 较大的年龄
D. 肿瘤发生的部位
E. 以上均与其相关

正确答案：D。肿瘤发生的部位

解析：肿瘤侵犯血管、坏死、多形性细胞群和较大的年龄均属于预后不良的相关因素。掌握“恶性黑色素瘤”知识点。